女，15岁。烦躁怕热，多汗，体重减轻2个月。查体：BP120/60mmHg，体型偏瘦，皮肤潮湿，手有震颤，轻微突眼，甲状腺弥漫I级，质地软，无触痛，可闻及轻度血管杂音，心率108次/分，经甲状腺功能检查确诊Graves病。首选的治疗是
A. 普萘洛尔
B. 碘剂
C. 丙硫氧嘧啶
D. 核素¹³¹I
E. 甲状腺大部切除

正确答案：C。丙硫氧嘧啶

解析：Graves病甲亢患者有3种治疗方法：抗甲状腺药物治疗、¹³¹I治疗及手术治疗。本例患者未满20岁，病情较轻，甲状腺轻度肿大，应首选抗甲状腺药物治疗。抗甲状腺药物包括硫脲类如丙硫氧嘧啶（C对）和咪唑类如他巴唑。普萘洛尔（A错）为常用β受体拮抗剂，主要通过阻断甲状腺激素对心脏的兴奋作用以控制甲亢症状，并不能减少甲状腺激素的产生。碘剂（B错）主要减少甲状腺激素的释放，仅能短期使用，多用于甲状腺手术的术前准备，长期使用可加重甲亢病情。核素¹³¹I（P686）（D错）多用于：①甲状腺肿大Ⅱ度以上；②对ATD（抗甲状腺药物）过敏；③ATD治疗或手术治疗后复发等，本例患者病情较轻，且未满20周岁，不宜使用核素¹³¹I，以免造成永久性甲低。甲状腺大部切除术（E错）主要用于20岁以上中、重度甲亢病人，本例患者病情较轻，未满20周岁不宜使用。